感冒夹惊的病位在
A. 肺脾
B. 肝脾
C. 肺肝
D. 肺肾
E. 肺心

正确答案：C。肺肝

解析：急性上呼吸道感染是指各种病原体侵犯喉部以上呼吸道的鼻、鼻咽和咽部的急性感染，相当于中医的感冒。小儿感冒发生的原因，以感受风邪为主，常兼寒、热、暑、湿、燥等。小儿肺常不足，当机体抵抗力低下时，外邪易于乘虚侵入而发为感冒。病变部位主要在肺，亦常累及肝、脾等脏。感冒夹惊，是因小儿神气怯弱，肝常有余，感邪之后，风邪入里化热，热扰神明，引动肝风所致，临床表现为心神不宁，睡卧不实，惊惕抽搐，故感冒夹惊的病位在肺肝（C对）。肺脾（A错）为感冒夹滞的病位。肝脾（B错）可为胎黄、新生儿缺氧缺血性脑病的病位。肺肾（D错）可为哮喘、急性肾小球肾炎的病位。肺心（E错）感冒夹惊的病位。